患者，男，27岁。患梅毒疳疮，色呈紫红，四周坚硬突起，伴腹股沟横痃质坚韧及肝脾肿大，舌淡紫苔腻，脉滑。其证候是
A. 肝经湿热
B. 痰瘀互结
C. 脾虚湿蕴
D. 气血两虚
E. 气阴两虚

正确答案：B。痰瘀互结

解析：淫秽疫毒循肝经下注并凝集于阴器，气血壅阻，痰瘀互结，故疳疮色呈紫红、四周坚硬突起、腹股沟横痃质坚韧及肝脾肿大，舌淡紫苔腻、脉滑为痰瘀互结之象（B对）。肝经湿热证：多见于一期梅毒。外生殖器疳疮质硬而润，或伴有横痃，杨梅疮多在下肢、腹部、阴部；兼见口苦口干，小便黄赤，大便秘结；舌质红，苔黄腻，脉弦滑（A错）。脾虚湿蕴可见食少纳呆，腹胀便溏等（C错）。气血两虚可见神疲乏力，面色无华，唇淡，脉细弱等（D错）。气阴两虚可见神疲乏力，口咽干燥，五心烦热等（E错）。